母婴同室最重要目的是
A. 便于母亲照顾婴儿
B. 增进母子感情
C. 及时发现婴儿的变化
D. 便于按需母乳喂养
E. 便于喂牛奶

正确答案：D。便于按需母乳喂养

解析：本题考查产后的保健工作。婴儿吸吮是促进母乳喂养重要因素，婴儿有力吸吮乳头的刺激，无论对乳汁的分泌或排空均十分重要，故按需喂养，当婴儿在饥饿时哺乳吸吮才有力。所以母婴同室可以便于按需母乳喂养（D对ABCE错），否则将影响婴儿吸吮母乳，从而影响乳汁的分泌。